咳嗽痰热郁肺证，其痰的特点是
A. 痰中带血、质稠、有腥臭味
B. 痰多、色黄、质稠
C. 痰白、质稀
D. 脓血相兼浊痰、有腥臭味
E. 痰少、质黏、夹有血丝

正确答案：B。痰多、色黄、质稠

解析：咳痰的特点多从痰的色、质、量、味等区别，咳嗽痰少，或干咳无痰者，多为燥热、气火、阴虚；痰多者，多为痰湿、痰热、虚寒；痰白清稀者，属风、属寒；痰白而稠厚者属湿；痰黄而黏稠者，属热；痰中带血者，多属肺热或肺阴虚。综合判断，咳嗽痰热郁肺者，痰多、质黏稠、色黄、或有热腥味（B对）。痰热灼伤肺络者可带有血丝。